关于妊娠期妇女拔牙哪项是正确的
A. 妊娠第1、2、3月期间
B. 妊娠第4、5、6月期间
C. 妊娠第7、8、9月期间
D. 拔牙对妊娠妇女无影响
E. 妊娠期间禁忌拔牙

正确答案：B。妊娠第4、5、6月期间

解析：本题考查妊娠期拔牙。妊娠期妇女拔牙正确的是妊娠第4、5、6月期间（B对）。妊娠第1、2、3月期间（A错）易发生流产，妊娠第7、8、9月期间（C错）易早产，故在第1、2、3月期间及第7、8、9月期间拔牙对妊娠妇女有影响（D错）。对引起极大痛苦，必须拔除的牙，在健康正常者的妊娠期第4、5、6月期间，是可以拔除的（B对E错）。